对低渗性脱水的描述不正确是
A. 以丢失细胞外液为主
B. 易发生休克
C. 早期尿少且比重高
D. 早期尿量一般不减少
E. 多因补液措施不当所致

正确答案：C。早期尿少且比重高

解析：低渗性脱水常见原因为补液措施不当（E对），特点是失Na＋多于失水，细胞外液渗透压降低使水向细胞内转移，加重细胞外液的丢失（A对），而易发生休克（B对）。血浆渗透压降低使抗利尿激素分泌减少，故早期尿量无明显减少（D对C错，为本题正确答案）。但在晚期血容量显著降低时，ADH释放增多，肾小管对水的重吸收增加，可出现少尿。